妇女普查普治的重点对象
A. 老年妇女
B. 更年期妇女
C. 已婚妇女
D. 所有妇女
E. 根据普查重点选择危险人群

正确答案：B。更年期妇女

解析：本题考查妇女普查普治的重点对象。妇女常见病筛查对象为各生命周期中的妇女，重点对象为更年期妇女（B对ACDE错）。